对A群链球菌最敏感，但对立克次体和螺旋体无效，甚至可促进立克次体生长的药物是
A. 大环内酯类
B. 青霉素类
C. 磺胺类
D. 喹诺酮类
E. 硝基咪唑类

正确答案：C。磺胺类

解析：磺胺类药物最敏感的是A群链球菌，对支原体、立克次体和螺旋体无效，甚至可促进立克次体生长。掌握“磺胺类及甲硝唑”知识点。